儿童期出现注意力不集中，离开母亲时有深感不安，焦虑，担心自己大祸临头，患者属于
A. 幻觉
B. 错觉
C. 感知综合障碍
D. 妄想症
E. 分离性焦虑

正确答案：E。分离性焦虑

解析：该病例是在儿童期出现注意力不集中，离开母亲（所依恋的对象）时深感不安、焦虑、大祸临头为主要表现，为分离性焦虑（E对）。幻觉是没有现实刺激作用于感觉器官时出现的知觉体验，是一种虚幻的知觉（A错）。错觉是对客观事物歪曲的知觉，如患者把输液管看成一条正在吸血的蛇等（B错）。感知综合障碍是指患者对客观事物的整体属性能够正确感知，但对某些个别属性如状、颜色、距离、空间位置等产生错误的感知（C错）。